泌乳素瘤应首选的治疗方法
A. 经蝶手术
B. 开颅手术
C. 长效奥曲肽
D. 放疗
E. 溴隐亭

正确答案：E。溴隐亭

解析：催乳素瘤治疗以药物为主，大腺瘤如果发生严重压迫症状可采用手术治疗。目前，卡麦角林被推荐为治疗催乳素瘤的首选药物，但无该选项，溴隐亭作为多巴胺受体激动剂已经有多年安全使用经验，且价格便宜，故临床中亦较常用（E对）。除催乳素瘤外，手术治疗通常是垂体瘤的首选治疗方式（AB错）。放疗起效慢，并发症多，很少作为垂体肿瘤的首选治疗方式，更多是作为手术及药物治疗的辅助手段，主要指征包括顽固性激素过度分泌、垂体肿瘤切除不全、有手术禁忌或术后肿瘤复发可能性大者（D错）。生长抑素类似物可抑制多种激素分泌，如GH和TSH等，目前已被用于治疗肢端肥大症和TSH分泌型肿瘤，常用生长抑素类似物有奥曲肽（C错）、兰瑞肽等。